关于传染病的治疗，下述哪一项是错误的
A. 治疗患者是预防措施中的重要环节之一
B. 治疗方案必须个体化
C. 传染病的病原疗法即抗生素疗法
D. 发热过高应采取对症治疗，加以控制
E. 聚肌胞可用于治疗某些病毒性疾病

正确答案：C。传染病的病原疗法即抗生素疗法